良性卵巢肿瘤伴右侧胸水形成可见于
A. 浆液性囊腺瘤
B. 粘液性囊腺瘤
C. 卵泡膜细胞瘤
D. 纤维瘤
E. 皮样囊肿

正确答案：D。纤维瘤

解析：良性卵巢肿瘤伴右侧胸水形成可见于纤维瘤（D对），称为梅格斯综合征，腹水经淋巴或横膈至胸腔，右侧横膈淋巴丰富，故多见右侧胸水（八年制第2版妇产科学P352）。卵泡膜细胞瘤（P330）（C错）常合并子宫内膜增生甚至发生癌变，无胸水形成，与纤维瘤同属于卵巢性索间质肿瘤。浆液性囊腺瘤（P326）（A错）为单侧，球形，大小不等，囊性；黏液性囊腺瘤（P326）（B错）多为单侧，圆形，体积较大，两者均属于卵巢上皮性肿瘤，无胸水形成。皮样囊肿（P329）（E错）又称成熟畸胎瘤，为良性肿瘤，属于卵巢生殖细胞肿瘤，可分泌甲状腺激素，无胸水形成。